医学伦理学的公正原则
A. 不同病人给于不同对待
B. 不同的经济给予不同的对待
C. 不同的需要给予不同的对待
D. 同样需要的人给予同样的对待
E. 不同的病情给予同样的对待

正确答案：D。同样需要的人给予同样的对待

解析：根据医学伦理学的公正原则，同样需要的人应给予同样的对待（D对）。